根管治疗术的核心思想是
A. 保留牙齿
B. 保留牙髓
C. 感染控制
D. 保留根尖乳头
E. 维持牙龈健康

正确答案：C。感染控制

解析：根管治疗术的核心思想是“感染控制”。掌握“根管治疗术概述”知识点。